以下有关急性放射病哪点是错误的
A. 是一种全身性疾病
B. 可以分为Ⅰ度和Ⅱ度
C. 根据临床特点和基本病理改变可分为骨髓型、胃肠型、脑型
D. 是人体一次或短时间内分次受到大剂量照射引起的
E. 是国家法定职业病

正确答案：B。可以分为Ⅰ度和Ⅱ度